运输内源性甘油三酯的脂蛋白是
A. IDL
B. VLDL
C. LDL
D. CM
E. HDL

正确答案：B。VLDL

解析：各种脂蛋白的功能：①VLDL（极低密度脂蛋白）（B对）主要转运内源性甘油三酯及胆固醇；②LDL（低密度脂蛋白）（C错）主要转运内源性胆固醇；③CM（乳糜微粒）（D错）主要转运外源性甘油三酯及胆固醇；④HDL（高密度脂蛋白）（E错）主要逆向转运胆固醇，即将肝外胆固醇逆向转运至肝内；⑤IDL（中间密度脂蛋白）（A错）是极低密度脂蛋白在血液运输当中的中间体。